以上哪种疾病的病理表现为呈波浪状，不全角化的复层扁平上皮、基层细胞水肿，界限清楚的基底细胞层、大量炎症细胞浸润的含有子囊的纤维囊壁
A. 成釉细胞瘤
B. 牙瘤
C. 牙源性角化囊性瘤
D. 化脓性腮腺炎
E. 含牙囊肿

正确答案：C。牙源性角化囊性瘤

解析：本题考查牙源性角化囊性瘤。病理表现为呈波浪状，不全角化的复层扁平上皮、基层细胞水肿，界限清楚的基底细胞层、大量炎症细胞浸润的含有子囊的纤维囊壁的为牙源性角化囊性瘤（C对）。牙源性角化囊性瘤具有独特的组织学特点：①衬里上皮较薄，一般无上皮钉突；②上皮表面呈波浪状或皱褶状，表层角化多呈不全角化；③棘细胞层较薄，常呈细胞内水肿；④基底细胞层界线清楚；⑤纤维性囊壁较薄，增厚的囊壁内有大量炎症细胞浸润；⑥纤维组织囊壁内有时可见微小的子囊和（或）上皮岛。